对于社区的理解，下列错误的是
A. 社区是以某种形式的社会组织或团体结合在一起的一群人
B. 我国农村社区范围为乡镇
C. 我国城市社区范围为街道
D. 社区就是社会
E. 社会不是简单的社区组合

正确答案：D。社区就是社会

解析：1987年在阿拉木图召开的初级卫生保健国际会议将社区定义为：以某种形式的社会组织或团体结合在一起的一群人。根据我国的行政区划特点和长期以来人们社会和经济生活的组织特征，一般认为在农村社区范围为乡镇，在城市社区范围为街道。社区不等于社会，它包括了社会有机体最基本的内容：但社会不是简单的社区组合，它具有超越各个具体社区的性质和特点。掌握“社区口腔卫生服务”知识点。